某女，45岁。因月经不调就诊，症见月经提前，经期延长，经血暗红，量少，咽干颧红，心烦潮热，腰膝酸软；舌红苔少，脉沉细无力。治以滋补肝肾、止血调经，处方如下：熟地黄12g，生山药9g，山萸肉9g，枸杞子9g，菟丝子12g，川牛膝9g，制何首乌12g，黄芩6g，女贞子12g，墨旱莲9g，仙鹤草12g，夏枯草9g，西洋参（另煎）6g，鹿角胶（烊化）6g，龟甲胶（烊化）9g；14剂，水煎服，每日1剂，早晚分服。经询问该患者既往无其他疾病，服用汤药期间未同时服用其他药物。推测处方中最有可能导致该患者出现上述症状的中药是
A. 黄芩
B. 川牛膝
C. 山萸肉
D. 夏枯草
E. 制何首乌

正确答案：E。制何首乌

解析：本题考查引起肝损伤的中药。处方中可以引起肝损伤的药物是制何首乌（E对）。引起肝损伤的中药：植物类文献报道多、有明确肝损伤的中药有柴胡、川楝子、苍术、苍耳子、栀子、吴茱萸、艾叶、山豆根、番泻叶、何首乌、黄药子、雷公藤等。其肝毒性与所含成分有关。以下几种情况可能增加何首乌致肝损伤风险。①超剂量、长期连续用药。②生何首乌较之制何首乌可能更易导致肝损伤。③有服用何首乌及其成方制剂引起肝损伤个人史的患者。④同时使用其他可导致肝损伤的药品。患者为崩漏之肝肾不足证【症状】月经非时而下，或月经先期，期延长，经血暗红，量少而淋沥不畅，咽干额红，心烦潮热，腰膝酸软。舌红苔少或光剥苔，脉沉细无力。【治法】滋补肝肾，止血调经。【方剂应用】1.基础方剂：左归丸合二至丸（熟地黄、山药、枸杞、山萸肉（C错）、菟丝子、鹿角胶、龟甲胶、川牛膝（B错）、女贞子、旱莲草）加黄芩（A错）、夏枯草（D错）、仙鹤草、制首乌。2.合理用药与用药指导：（1）饮片选择：左归丸出自明代《景岳全书》。选用盐炙菟丝子，长于平补肝肾阴阳；选用酒炙山茱萸，增强滋补作用。（2）剂量建议：何首乌有致肝损伤的不良反应报道，应避免长期大量服用，《药典》规定内服剂量为6～12g。（3）煎法服法：水煎温服，每日2～3次，餐前服用。鹿角胶、龟甲胶可单独烊化兑服。实证、热证，及有外感症状时不宜服用。